苦参中的生物碱是
A. 色胺吲哚类生物碱
B. 双吲哚类生物碱
C. 双稠哌啶类生物碱
D. 吗啡烷类生物碱
E. 异喹啉类生物碱

正确答案：C。双稠哌啶类生物碱

解析：本题考查的是苦参的化学成分。苦参中的生物碱是双稠哌啶类生物碱（C对）。苦参中主要生物碱及其化学结构：苦参所含主要生物碱是苦参碱和氧化苦参碱，《中国药典》以其为指标成分进行鉴别和含量测定，含量测定要求苦参碱和氧化苦参碱总量不得少于1.2%。此外还含有羟基苦参碱、N-甲基金雀花碱、安那吉碱、巴普叶碱和去氢苦参碱（苦参烯碱）等。这些生物碱都属于双稠哌啶类。双稠哌啶类生物碱：由两个哌啶环共用一个氮原子稠合而成的杂环，具喹喏里西啶的基本母核。主要分布于豆科、石松科和千屈菜科。如苦参中的苦参碱、氧化苦参碱，野决明中的金雀花碱等。色胺吲哚类（A错）生物碱：含有色胺部分，结构较简单。如吴茱萸中的吴茱萸碱。双吲哚类（B错）生物碱：是由两分子单吲哚类生物碱聚合而成的衍生物，如长春花中具有抗癌作用的长春碱和长春新碱。吗啡烷类（D错）生物碱：具有部分饱和的菲核，如罂粟中的吗啡、可待因，青风藤中的青风藤碱等。异喹啉类生物碱（E错）：来源于苯丙氨酸和酪氨酸系，具有异喹啉或四氢异喹啉的基本母核，在植物中分布广泛，数目较多，具有多方面的生物活性。